膝中至外踝尖的骨度分寸是
A. 12寸
B. 13寸
C. 16寸
D. 18寸
E. 19寸

正确答案：C。16寸

解析：膝中即为腘横纹，其至外踝尖的距离为16寸（C对）。12寸为肘横纹（平肘尖）至腕掌（背）侧横纹的距离（A错）。13寸为胫骨内侧髁下方至内踝尖的距离（B错）。18寸为横骨上廉至内辅骨上廉的距离（D错）。19寸为股骨大转子至腘横纹的距离（E错）。